CPI指数为2时，是指
A. 探诊有牙石，但探针黑色部分全部露在龈袋外
B. 牙龈健康
C. 牙龈炎，探诊后出血
D. 早期牙周病，龈袋深度4～5mm
E. 晚期牙周病，牙周袋深度6mm或以上

正确答案：A。探诊有牙石，但探针黑色部分全部露在龈袋外

解析：本题考查牙周病流行病学及分级预防。CPI指数为2时，是指探诊有牙石，但探针黑色部分全部露在龈袋外（A对）。0＝牙龈健康；1＝龈炎，探诊后出血；2＝牙石，探诊可发现牙石，但探针黑色部分全部露在龈袋外；3＝早期牙周病，龈缘覆盖部分探针黑色部分，龈袋深度在4～5mm；4＝晚期牙周病，探针黑色部分被龈缘完全覆盖，牙周袋深度在6mm或以上；X＝除外区段（少于两颗功能牙存在）；9＝无法检查。